中央性颌骨癌的临床及病理特征中，正确的是
A. 主要发生自牙胚成釉上皮的剩余细胞
B. 好发于下颌磨牙区
C. 一般应行选择性颈淋巴清扫术
D. 应配合化疗，为了防止远处转移
E. 以上均正确

正确答案：E。以上均正确

解析：中央性颌骨癌主要发生自牙胚成釉上皮的剩余细胞。好发于下颌骨，特别是下颌磨牙区。患者早期无自觉症状，以后可以出现牙痛、局部疼痛，并相继出现下唇麻木。掌握“中央性颌骨癌及上颌窦癌”知识点。